败毒散的药物组成不包括
A. 柴胡、前胡
B. 羌活、独活
C. 桔梗、枳壳
D. 人参、生姜
E. 当归、芍药

正确答案：E。当归、芍药

解析：败毒散的药物组成是柴胡、前胡、羌活、独活、茯苓、川芎、枳壳、桔梗、人参、生姜、薄荷（E错，为本题正确答案）（人参败毒茯苓草，枳桔柴前羌独芎，薄荷少许姜三片，时行感冒有奇功）。